药物剂量过大或体内蓄积过多时会发生
A. 继发反应
B. 毒性反应
C. 特异质反应
D. 后遗效应
E. 停药反应

正确答案：B。毒性反应

解析：本题考查药品不良反应。药物剂量过大或体内蓄积过多时会发生毒性反应（B对）。毒性反应是指在药物剂量过大或体内蓄积过多时发生的危害机体的反应。继发反应（A错）是由于药物的治疗作用所引起的不良后果，又称治疗矛盾。特异质反应（C错）是指少数特异体质患者对某些药物反应异常敏感。后遗效应（D错）是指在停药后血药浓度已降低至最低有效浓度以下时仍残存的药理效应。停药反应（E错）是指患者长期应用某种药物，突然停药后出现原有疾病加剧的现象，又称回跃反应或反跳。